较大的囊肿可将舌抬起，状似“重舌”，是哪种囊肿的特征性表现
A. 舌下腺囊肿单纯型
B. 舌下腺囊肿口外型
C. 皮样囊肿
D. 表皮样囊肿
E. 囊性水瘤

正确答案：A。舌下腺囊肿单纯型

解析：单纯型为典型的舌下腺囊肿表现，占舌下腺囊肿的大多数。囊肿位于下颌舌骨肌以上的舌下区，由于囊壁菲薄并紧贴口底黏膜，囊肿呈浅紫蓝色，扪之柔软有波动感。囊肿常位于口底的一侧，有时可扩展至对侧，较大的囊肿可将舌抬起，状似“重舌”。掌握“舌下腺及唾液腺黏液囊肿”知识点。